某医师要寻找一个指标来反映疾病与病因联系强度，下列指标中最好的是
A. 潜伏期
B. 特异危险性
C. 相对危险度
D. 致病因子的流行率
E. 总人口的疾病发病率

正确答案：C。相对危险度

解析：本题考查相对危险度的概念。相对危险度（C对ABDE错）（RR）通常包括了危险度比或率比。危险度比是暴露组的危险度（测量指标是累积发病率）与对照组的危险度之比。率比是暴露组与对照组的发病密度之比。危险度比和率比都是反映暴露与发病（死亡）关联强度的最有用的指标。